男性，70岁，无牙颌5年。初戴全口义齿时，当医生用双手示指分别放在上颌义齿两侧前磨牙区（牙合）面左右交替按压时，见义齿有左右翘动现象。为消除义齿的这种翘动，首选的处理方法是
A. 基托组织面衬垫
B. 缓冲局部基托组织面
C. 修整基托边缘
D. 调整平衡
E. 重做义齿

正确答案：B。缓冲局部基托组织面

解析：为防止上颌义齿以此为支点而产生翘动和压痛，义齿基托组织面相应处需做缓冲处理。多数腭隆突较平坦，个别腭隆突过大甚至呈结节状，可能影响义齿基托的伸展，需在修复前进行外科手术切除。掌握“全口义齿戴入后问题及处理”知识点。